用作改善制剂外观的着色剂是
A. 羟苯酯类
B. 阿拉伯胶
C. 阿司帕坦
D. 胡萝卜素
E. 氯化钠

正确答案：D。胡萝卜素

解析：本题考查液体制剂常用的附加剂。胡萝卜素（D对）为改善制剂外观的着色剂。羟苯酯类（A错）为防腐剂；阿拉伯胶（B错）主要作为可以食用的稳定剂、乳化剂、增黏剂和赋形剂；阿司帕坦（C错）是一种合成的二肽类甜味剂；氯化钠（E错）为液体制剂制备中常用的渗透压调节剂。